位于粒层的深部，细胞体积大，多边形，由增生的基底细胞发育而来的是
A. 角化层
B. 粒层
C. 棘细胞层
D. 基底层
E. 生发层

正确答案：C。棘细胞层

解析：棘细胞层：位于粒层的深部，细胞体积大，多边形，由增生的基底细胞发育而来，胞质常伸出许多小的刺状突起，称细胞间桥。在透射电镜下观察，细胞间桥的突起相连为桥粒。构成桥粒的蛋白质主要有桥粒芯蛋白和桥粒胶蛋白。掌握“口腔黏膜基本结构”知识点。